以下哪一项不应是单位和个人应对精神障碍患者保密的是
A. 姓名
B. 性别
C. 肖像
D. 住址
E. 工作单位

正确答案：B。性别